位于头部眉上1寸，瞳孔直上的腧穴是
A. 四白
B. 隐白
C. 承泣
D. 阳白
E. 睛明

正确答案：D。阳白

解析：该题主要考察腧穴定位。阳白定位在头部，眉上1寸，瞳孔直上（D对）。四白定位在面部，眶下孔处（A错）。隐白定位在足趾，大趾末节内侧，趾甲根角侧后方0.1寸（B错）。承泣定位在面部，眼球与眶下缘之间，目正视，瞳孔直下（C错）。睛明定位在面部，目内眦内上方眶内侧壁凹陷中（E错）。